某市近30年烟草的消耗量呈逐年上升趋势，同时该市的肺癌死亡率也呈上升趋势，有人对此进行了相关分析，这类研究属于
A. 现况调查
B. 病例对照研究
C. 实验研究
D. 生态学研究
E. 队列研究

正确答案：D。生态学研究